下列哪一项是原发于口底黏膜的癌
A. 舌癌
B. 颊癌
C. 腭癌
D. 牙龈癌
E. 口底癌

正确答案：E。口底癌

解析：口底癌系指原发于口底黏膜的癌，与来自舌下腺的癌应有所区别。掌握“颊癌、口底癌及唇癌”知识点。